女，78岁。跌倒右髋受伤2小时。局部疼痛，活动受限，患肢缩短，轴向叩击痛（+）。X线片显示右股骨颈基底部骨皮质连续性中断，断端嵌插，Pauwells角25°，一般状态差。既往高血压，肺心病，糖尿病病史30余年，心功能Ⅳ级。最佳治疗方案是
A. 闭合复位内固定
B. 切开复位内固定
C. 下肢中立位皮牵引6～8周
D. 转子间截骨矫正力线
E. 人工关节置换术

正确答案：C。下肢中立位皮牵引6～8周

解析：老年女性患者，跌倒后，右髋局部疼痛、活动受限、患肢缩短、轴向叩击痛（+）（提示可能为股骨颈骨折），X线片示右股骨颈基底部骨皮质连续性中断，Pauwels角25°（外展型骨折Pauwels角＜30°，内收型骨折Pauwels角＞50°），结合患者临床表现、体查和影像学检查，该患者最可能的诊断为右侧股骨颈外展型骨折，为稳定性骨折。患者年龄较大，既往高血压，肺心病，糖尿病病史30余年，心功能Ⅳ级，全身情况较差，难以耐受手术，应选择非手术治疗，如穿防旋鞋，下肢中立位皮牵引6～8周（C对）等。闭合复位内固定（A错）常用于儿童股骨颈骨折的治疗。切开复位内固定（B错）主要用于内收型、有明显移位的股骨颈骨折。人工关节置换（E错）用于65岁以上全身情况较好的老年人的股骨颈头下型骨折，而患者为股骨颈基底骨折，故不适用。转子间截骨矫正力线（D错）常用于股骨颈骨折不愈合的病人。